属于唇周围肌上组的是
A. 笑肌
B. 颏肌
C. 降口角肌
D. 降下唇肌
E. 以上均是

正确答案：A。笑肌

解析：唇周围肌上组：主要有笑肌、颧大肌、颧小肌、提上唇肌、提上唇鼻翼肌、提口角肌。掌握“表情肌、舌腭肌”知识点。